敌百虫口服中毒不能用下列哪种溶液洗胃
A. 高锰酸钾溶液
B. 生理盐水
C. 饮用水
D. 碳酸氢钠溶液
E. 醋酸溶液

正确答案：D。碳酸氢钠溶液